女，42岁。乏力怕冷，便秘伴声音嘶哑1年，体重增加8kg。经检查诊断为甲状腺功能减退症，拟左甲状腺素替代治疗。最适宜的起始剂量为
A. 125μg
B. 100μg
C. 75μg
D. 50μg
E. 25μg

正确答案：E。25μg

解析：甲状腺功能减退常用左甲状腺素作替代治疗，一般从25～50μg/d开始，由于激素替代治疗常从小剂量开始，逐渐增加至生理量，所以最适宜的起始剂量为25μg（E对）。